男孩，1.5岁。半后半年发现尿有怪臭味，一岁时发现智力较同龄儿童低，尿有霉臭味，近1个月经常抽搐发作。体检：表情呆滞，毛发棕黄，面部湿疹，皮肤白皙。最可能的诊断
A. 21-三体综合征
B. 苯丙酮尿症
C. 呆小病
D. 癫病
E. 佝偻病性手足抽搐症

正确答案：B。苯丙酮尿症

解析：尿有鼠尿味为苯丙酮尿症（PKU）的特征性表现，患儿智能发育落后、头发色素变浅，间断抽搐，应诊断为PKU（B对）。其他选项均不会出现鼠尿臭味、毛发棕黄。